男，25岁。诊断精神分裂症，服用氟哌啶醇12mg/d，治疗2年，病情稳定。半年来出现明显的吐舌、不自觉咀嚼和扭动四肢，其症状符合
A. 腹泻
B. 肌紧张
C. 癫痫发作
D. 迟发性运动障碍
E. 体位性低血压

正确答案：D。迟发性运动障碍

解析：长期服用氟哌啶醇（传统性抗精神病药物）最常见的不良反应是椎体外系反应。抗精神病药物不良反应包括：1.椎体外系反应：①急性肌张力障碍；②静坐不能；③类帕金森症；④迟发性运动障碍（D对）。2.自主神经：①抗胆碱能的副作用：表现为口干、视力模糊、排尿困难和便秘等；②α肾上腺素能阻滞作用：表现为体位性低血压、反射性心动过速等。